眼的屈光系统包括
A. 角膜
B. 巩膜
C. 虹膜
D. 脉络膜
E. 视网膜虹膜部

正确答案：A。角膜

解析：角膜（A对）、房水、晶状体和玻璃体合称眼的屈光系统，但巩膜（B错）、虹膜（C错）、脉络膜（D错）和视网膜虹膜部（E错）不包括在其中。